抗胸腺细胞球蛋白（ATG）治疗重型再生障碍性贫血的机制是
A. 刺激造血干细胞增殖
B. 抑制T细胞，使造血功能恢复
C. 稳定血管内皮细胞，减少出血
D. 改善骨髓微环境
E. 提高体内EPO水平

正确答案：B。抑制T细胞，使造血功能恢复

解析：抗胸腺细胞球蛋白（ATG）是从经过人胸腺淋巴细胞免疫后的动物高免疫血清中提取的一种γ球蛋白，为强力免疫抑制剂，可抑制抑制性T淋巴细胞对骨髓造血的抑制作用，使造血功能恢复（B对）。抗胸腺细胞球蛋白不具有刺激造血干细胞增殖（A错）、稳定血管内皮细胞，减少出血（C错）、改善骨髓微环境（D错）、提高体内EPO水平（E错）等作用。